区分流感病毒亚型的依据是
A. RNA﹢NA
B. RNA﹢HA
C. NA﹢NP
D. HA﹢NP
E. HA﹢NA

正确答案：E。HA﹢NA